抗菌谱最广，抗菌作用最强的药物是
A. 第一代头孢菌素
B. 第二代头孢菌素
C. 第三代头孢菌素
D. 第四代头孢菌素
E. 碳青霉烯类抗生素

正确答案：E。碳青霉烯类抗生素

解析：本题考查碳青霉烯类抗生素。碳青酶烯类（E对）抗菌谱最广、抗菌活性强。第一代头孢菌素（A错）对革兰阳性菌包括耐青霉素金黄色葡萄球菌的抗菌作用强，对革兰阴性杆菌较弱。第二代头孢菌素（B错）对革兰阳性菌的抗菌活性较第一代略差或相仿，对革兰阴性菌的抗菌活性较第一代强，较第三代弱。第三代头孢菌素（C错）对革兰阳性菌抗菌活性较第一、二代弱，对革兰阴性菌抗菌作用强。第四代头孢菌素（D错）对革兰阳性菌、革兰阴性菌、厌氧菌显示广谱抗菌活性。